某男，65岁。咳喘10余年，气短乏力，痰多清稀，食纳减少，腹胀便溏，足面浮肿。舌淡苔白，脉细弱。中医辨证是
A. 肾不纳气
B. 肺肾两虚
C. 心肾阳虚
D. 心肺两虚
E. 肺脾两虚

正确答案：E。肺脾两虚

解析：本题考查的是肺脾两虚证的临床表现。咳喘10余年，气短乏力，痰多清稀，食纳减少，腹胀便溏，足面浮肿。舌淡苔白，脉细弱。中医辨证是肺脾两虚（E对）。肺脾两虚证的临床表现及辨证要点：肺脾两虚证的临床表现，常见久咳不已，短气乏力，痰多清稀，食纳减少，腹胀便溏，甚则足面浮肿，舌淡苔白，脉细弱。肾不纳气（A错）证的临床表现，常见气虚喘促，呼多吸少，动则喘甚，汗出，四肢不温，恶风寒，面部虚浮，舌质淡，脉虚弱。肺肾两虚（B错）常指肺肾阴虚证。肺肾阴虚证的临床表现及辨证要点：肺肾阴虚证的临床表现，常见咳嗽痰少，动则气促，间或咯血，腰膝酸软，消瘦，骨蒸潮热，盗汗遗精，颧红，舌红苔少，脉细数。这些症状，均由肺肾阴虚、阴虚内热、虚火上炎所引起。心肾阳虚（C错）可见神疲欲寐，闭眼即睡，呼之即醒或蒙胧迷糊，似睡非睡，似醒非醒者，又称之为“但欲寐”。心肺两虚（D错）证的临床表现，常见久咳不已，气短心悸，面色白，甚者可见口唇青紫，舌淡，脉细弱。